艾滋病防治工作原则的表述不正确的是
A. 坚持预防为主，防治结合的方针
B. 建立政府组织领导，部门各负其责，全社会共同参与的机制
C. 加强宣传教育
D. 采取行为干预和关怀救助等措施
E. 坚持预防为主，治疗为辅的方针

正确答案：E。坚持预防为主，治疗为辅的方针

解析：艾滋病防治方针：艾滋病防治工作坚持预防为主、防治结合的方针（E错，为本题正确答案）（A对），建立政府组织领导、部门各负其责、全社会共同参与的机制（B对），加强宣传教育（C对），采取行为干预和关怀救助等措施（D对），实行综合防治。